系统性红斑狼疮患者阳性率最高的抗体是
A. 抗Sm抗体
B. 抗SSA抗体
C. 抗dsDNA抗体
D. 抗核抗体ANA
E. 抗RNA抗体

正确答案：D。抗核抗体ANA

解析：抗核抗体（ANA）：是对各种细胞核成分抗体的总称。SLE的ANA阳性率高达95%，其滴定度较高，大于1:80的ANA对SLE的诊断意义大。ANA对SLE也无特异性，也可见于其他结缔组织病，如硬皮病、舍格伦综合征等，但其阳性率和滴定度较低。周边型及均质型多见于SLE，有一定诊断意义（D对）；抗Sm抗体对系统性红斑狼疮的诊断有较高特异性，是公认的系统性红斑狼疮的血清标志性抗体，阳性率为20%～40%，抗Sm抗体阴性并不能排除系统性红斑狼疮的诊断（A错）；抗SSA抗体在系统性红斑狼疮的阳性率是20%～60%（B错）；抗dsDNA抗体主要出现于系统性红斑狼疮患者的血清中，对系统性红斑狼疮患者的组织器官损伤有致病作用，抗dsDNA抗体对于诊断狼疮有较高的特异性，而且与系统性红斑狼疮的活动性相关，阳性率为50%～80%，抗体效价随病情缓解而下降（C错）；抗RNA抗体在系统性红斑狼疮抗体检测中阳性率为26%（E错）。